患者，男，28岁。上腹部灼痛1年，饥饿时加重，进食后可缓解，伴泛酸。查体：上腹部稍偏右有压痛。应首先考虑的是
A. 慢性胃炎
B. 慢性胆囊炎
C. 十二指肠溃疡
D. 胰腺炎
E. 胃癌

正确答案：C。十二指肠溃疡

解析：患者青年男性（十二指肠溃疡好发人群），上腹部灼痛1年，饥饿时加重，进食后可缓解（十二指肠溃疡典型腹痛特点），伴反酸。查体：上腹部稍偏右有压痛，应首先考虑的是十二指肠溃疡（C对）。慢性胃炎（P366）（A错）多无明显症状；慢性胆囊炎（八版外科学P461）（B错）常在饱餐、进食油腻食物后出现腹胀、腹痛等；胰腺炎（P440）（D错）常为较剧烈的急性腹痛，多为于中左上腹，部分患者腹痛向背部放射；胃癌（P376）（E错）多有消化不良、纳差、厌食、乏力及体重减轻等症状，后四种疾病均不会出现节律性的饥饿痛。